东莨菪碱具有
A. 发汗、平喘作用
B. 抗菌作用
C. 降血脂作用
D. 镇静、麻醉作用
E. 消肿利尿、抗肿瘤作用

正确答案：D。镇静、麻醉作用

解析：本题考查的是洋金花中生物碱的药理作用。东莨菪碱具有镇静、麻醉作用（D对）。洋金花中生物碱的药理作用：莨菪碱及其外消旋体阿托品有解痉镇痛、解有机磷中毒和散瞳作用；东莨菪碱除具有莨菪碱的生理活性外，还有镇静、麻醉作用。发汗、平喘作用（A错）为麻黄的药理作用。麻黄的药理作用：（1）发汗；（2）平喘、镇咳、祛痰；（3）利尿；（4）解热、镇痛、抗炎。抗菌作用（B错）为黄连的药理作用。黄连的药理作用：（1）抗菌、抗病毒；（2）抗毒素、抗腹泻；（3）解热、抗炎；（4）降血糖。降血脂作用（C错）为何首乌的药理作用。何首乌的药理作用：（1）促进造血功能；（2）降血脂、抗动脉粥样硬化；（3）增强免疫功能。消肿利尿、抗肿瘤作用（E错）为苦参的药理作用。苦参的药理作用：苦参总生物碱具有抗肿瘤、抗病原微生物、抗心律失常、解热、抗炎、抗变态反应和调节免疫等作用。